与机体津液输布排泄相关的有
A. 肺的呼吸
B. 肾的蒸腾气化
C. 汗液的排泄
D. 尿液的形成排泄
E. 气机的升降疏泄

正确答案：A、B、C、D。肺的呼吸；肾的蒸腾气化；汗液的排泄；尿液的形成排泄

解析：本题考查的是津液代谢。与机体津液输布排泄相关的有肺的呼吸（A对）、肾的蒸腾气化（B对）、汗液的排泄（C对）与尿液的形成排泄（D对）。津液的生成，依赖于脾胃对饮食物的运化功能；津液的输布，则依靠脾的“散精”和肺的“通调水道”功能，津液的排泄则主要通过汗液、尿液和呼气的形式而实现，津液在体内的升降出入，则是在肾的气化蒸腾作用下，以三焦为通道，随着气的升降出入，布散于全身而环流不息。可见津液的代谢过程，依赖于气和许多脏腑一系列生理功能的协调配合，其中尤以肺、脾、肾三脏的生理功能起着主要的调节平衡作用。气机的升降疏泄（E错）为肝的生理功能。肝的生理功能。肝的生理功能主要有两方面：一是主疏泄，二是藏血。1.肝主疏泄：肝主疏泄，是指肝气具有疏通、畅达全身气机，进而调畅精血津液的运行输布、脾胃之气的升降、胆汁的分泌排泄以及情志活动等作用。肝的疏泄功能反映了肝为刚脏、主升、主动的生理特点，中心环节是调畅全身气机。肝主疏泄，调畅全身气机功能，具体体现在五个方面：（1）调畅情志。（2）协调脾胃升降。（3）促进胆汁生成与排泄。（4）促进血液运行和津液代谢。（5）调畅排精行经。2.肝主藏血：肝藏血，是指肝具有贮藏血液、调节血量和防止出血的功能。（1）贮藏血液。（2）调节血量。（3）防止出血。